受MHC限制的细胞间相互作用发生在
A. 巨噬细胞与肿瘤细胞
B. 肥大细胞与T淋巴细胞
C. 中性粒细胞与B淋巴细胞
D. NK细胞与病毒感染细胞
E. T淋巴细胞与树突状细胞

正确答案：E。T淋巴细胞与树突状细胞

解析：MHC限制性是指T细胞以其TCR（T细胞抗原受体）对抗原肽和自身MHC分子进行双重识别，即T细胞只能识别自身MHC分子提呈的抗原肽，根据MHC限制性的定义可知，MHC限制的过程中有T淋巴细胞的参与（ACD错），树突状细胞为专职抗原提呈细胞，故受MHC限制的细胞间相互作用可发生在T淋巴细胞与树突状细胞（E对B错）之间。